职工基本医疗保险费用的缴付主要为
A. 职工个人和国家
B. 用人单位和职工个人
C. 用人单位
D. 国家和用人单位
E. 国家

正确答案：B。用人单位和职工个人

解析：国家基本医疗保险是为补偿劳动者因疾病风险造成的经济损失而建立的一项社会保险制度。通过用人单位和个人缴费，建立医疗保险基金，参保人员患病就诊发生医疗费用后，由医疗保险经办机构给予一定的经济补偿，以避免或减轻劳动者因患病、治疗等所带来的经济风险（B对）。